输卵管妊娠胚胎死亡的可靠依据是
A. 阴道少量流血
B. 排出蜕膜管型
C. 尿妊娠试验阴性
D. 早孕反应消失
E. 腹痛减轻

正确答案：B。排出蜕膜管型

解析：输卵管妊娠和正常妊娠一样，滋养细胞产生的hCG维持黄体生长，使甾体激素分泌增加，因此，月经停止来潮，子宫增大变软，子宫内膜出现蜕膜反应。若胚胎受损或死亡，滋养细胞活力消失，蜕膜自宫壁剥离而发生阴道流血。有时蜕膜可完整剥离，遂阴道流血排出三角形蜕膜管型。掌握“异位妊娠”知识点。